下列属于根据消毒物品的性质选择消毒方法的是
A. 对高度危险器械，须选用灭菌方法处理
B. 器械在浸泡灭菌时，应选择对金属基本无腐蚀性的消毒剂
C. 对中度危险器械，须进行中水平或高水平消毒处理
D. 对受到一般细菌和亲脂病毒等污染的物品，可选用中水平或低水平消毒法
E. 对受到细菌芽胞、真菌孢子污染的物品选用高水平消毒法或灭菌法

正确答案：B。器械在浸泡灭菌时，应选择对金属基本无腐蚀性的消毒剂

解析：根据消毒物品的性质选择消毒方法：①耐高温、耐湿度的物品和器材，应首选压力蒸汽灭菌；耐高温的玻璃器材、油剂类和干粉类等可选用干热灭菌。②不耐热、不耐湿以及贵重物品，可选择环氧乙烷或低温蒸汽甲醛气体消毒、灭菌。③器械在浸泡灭菌时，应选择对金属基本无腐蚀性的消毒剂。掌握“口腔器械的消毒与灭菌及医疗废物处理”知识点。